非特异性感染中，不应出现的病理改变是
A. 炎症介质细胞因子释放
B. 血管通透性增加
C. 血浆成份渗出
D. 干酪样坏死
E. 转为慢性炎症

正确答案：D。干酪样坏死

解析：非特异性感染主要指化脓性细菌引起的感染，同一种致病菌可引起多种不同的化脓性感染，而不同的致病菌也可引起相同的疾病。其病理改变主要有炎症介质、细胞因子释放（A对），血管通透性增加（B对），血浆成份渗出（C对）等，若致炎因子不能在短期内被清除，在机体内持续起作用，可逐渐转变为慢性炎症（E对）。与非特异性感染相对应的是特异型感染，主要指某些特定的非化脓性细菌引起的感染，同一种疾病由相同的致病菌引起。干酪样坏死多见于由结核分枝杆菌感染引起的结核肉芽肿中，属于特异性感染（D错，为本题正确答案）。